用高效液相色谱测定药物含量时应选用的色谱法参数是
A. 保留时间
B. 峰面积
C. 峰宽
D. 半峰宽
E. 标准差

正确答案：B。峰面积

解析：本题考查高效液相色谱法。用高效液相色谱测定药物含量时应选用的色谱法参数是峰面积（B对）。每一个组分的色谱峰可用三项参数说明：峰高或峰面积（用于定量）；峰位（用保留值（A错）表示，用于定性）；峰宽（CD错）（用于衡量柱效）。药物含量属于定量分析，选用的色谱参数是峰面积。标准差（E错）常作为精密度验证指标之一。